板蓝根水煎液置紫外光灯下显
A. 蓝紫色荧光
B. 黄棕色荧光
C. 蓝色荧光
D. 棕红色荧光
E. 淡绿色荧光

正确答案：C。蓝色荧光